连翘用治热淋涩痛的机理是
A. 凉血止血
B. 渗湿止痛
C. 利湿去浊
D. 收涩止痛
E. 清心利尿

正确答案：E。清心利尿

解析：】连翘功效为清热解毒，消肿散结，疏散风热。主入心经，清心火，消肿散结，有“疮家圣药”之称，“诸痛痒疮皆属于心”是也，治热淋也是上清心火，下利小便之功（E对）。